导致心力衰竭前负荷不足的疾病是
A. 主动脉瓣狭窄
B. 梗阻性心肌病
C. 主动脉瓣关闭不全
D. 二尖瓣关闭不全
E. 二尖瓣狭窄

正确答案：E。二尖瓣狭窄

解析：心室前负荷指的是容量负荷，是指心肌收缩之前遇到的负荷；后负荷指的是压力负荷，是克服血压来泵血的过程，一般指主动脉的压力。主动脉瓣狭窄时，收缩期左心室排血受阻，后负荷加大，为维持静息时正常的心排血量，左室收缩力增强，左室壁代偿性肥厚（A错）。梗阻性（肥厚型）心肌病，是指室间隔高度肥厚向左心室内突出，收缩时引起心室流出道梗阻者，应是后负荷增大（B错）。主动脉瓣关闭不全时，左室充盈过度，容量负荷增加，左心室先扩大随后肥厚，并非前负荷不足（C错）。二尖瓣关闭不全时，收缩期部分血液反流入左心房，左房充盈增加；舒张期左心室接受较正常更多的从左房进入左室的血液，致左心室容量负荷增加（D错）。二尖瓣狭窄时，舒张期左房内血液进入左室障碍，左室容量负荷降低。长期肺循环压力增高，造成肺动脉高压，加重右心室后负荷，出现右心室肥厚、扩大，最终导致右心衰竭（E对）。